全身应用治疗结核病，局部用药治疗可治疗眼睛的感染性疾病的是
A. 利福平
B. 异烟肼
C. 妥布霉素
D. 金霉素
E. 氯霉素

正确答案：A。利福平

解析：利福平与其他抗结核药联合使用可治疗各种类型的结核病，局部用药可用于沙眼、急性结膜炎及病毒性角膜炎的治疗。掌握“异烟肼、利福平及乙胺丁醇”知识点。